霍乱病人或疑似病人以及密切接触者及其他有关单位和人员，拒绝配合疾病预防控制机构和医疗机构采取预防控制的，可依法予以协助强制执行的机关是
A. 民政机关
B. 司法机关
C. 公安机关
D. 监察机关
E. 审计机关

正确答案：C。公安机关